连续使用易产生耐受性的药物是
A. 普萘洛尔
B. 哌唑嗪
C. 氨氯地平
D. 硝酸甘油
E. 氯沙坦

正确答案：D。硝酸甘油

解析：本题考查硝酸甘油。硝酸甘油（D对）属于硝酸酯类，所有的硝酸酯类连续使用都有耐药现象。普萘洛尔（A错）、哌唑嗪（B错）、氨氯地平（C错）及氯沙坦（E错）连续使用也不会造成耐药性。